女，45岁。1天前感冒后出现发热，全身无力。厌食。腹泻，既往sheehan综合征15年。口服泼尼松5mg/d治疗，查体：T38.1℃，BP82/40mmHg，神志淡漠，肺部听诊未见异常，心率92次/分，FBG（空腹血糖）3.3mmol/L，目前最有效的治疗是
A. 静脉补液治疗
B. 静脉注射葡萄糖
C. 静脉注射升压药物
D. 静脉注射氢化可的松
E. 口服泼尼松增加剂量

正确答案：B。静脉注射葡萄糖

解析：生育后妇女因产后腺垂体发生缺血性坏死，称为Sheehan综合征。垂体危象是在全垂体功能减退基础上，各种应激如感染、腹泻、饥饿、寒冷、外伤等均可诱发，临床呈现高热型、低热型、低血糖型、低血压、循环衰竭型等。各种类型可伴有相应的症状，如高热、循环衰竭、休克、恶心、呕吐、头痛、神志不清、昏迷等严重垂危状态。该患者既往Sheehan综合征15年，1天前感冒（诱因）后出现发热，全身无力，厌食，腹泻，查体：T38.1℃，BP82/40mmHg，FBG（空腹血糖）3.3mmol/L，神志淡漠（垂体危象的表现）。结合患者的病史、症状、体征，诊断患者出现垂体危象。其治疗首先给予静脉推注50%葡萄糖液40～80ml抢救低血糖，继而补充5%葡萄糖盐水滴注，以解除急性肾上腺功能减退危象（B对D错）。单纯静脉补液治疗，不能抢救垂体危象（A错）。静脉注射升压药物为出现休克患者的对症治疗（C错）。口服泼尼松增加剂量，为日常激素替代治疗，不是抢救措施（E错）。